男，69岁。反复咳嗽、咳痰、喘息20年，加重2周，嗜睡1周。无发热、咯血。既往吸烟30年，每日约1包。查体T36.8℃，BP160/95mmHg，昏睡状，口唇发绀，颈静脉充盈，肝颈静脉回流征阳性，双肺可闻及哮鸣音和细湿啰音，心率130次/分，P₂＞A₂，双下肢水肿，病理征（-）。该患者肺动脉高压形成的最主要机制是
A. 缺氧、CO₂潴留致血管收缩
B. 原位血栓形成
C. 肺毛细血管静水压升高
D. 肺小动脉结构重塑
E. 血红蛋白浓度升高

正确答案：A。缺氧、CO₂潴留致血管收缩

解析：患者为老年男性，有长期吸烟史（为慢阻肺常见的危险因素），咳嗽、咳痰、喘息20年（为慢阻肺典型的表现），可初步诊断为慢性阻塞性肺疾病（COPD）。患者昏睡状，口唇发绀，颈静脉充盈，肝颈静脉回流征阳性，双下肢水肿，双肺可闻及哮鸣音和细湿啰音，心率快，P₂＞A₂，提示右心衰和肺动脉高压，符合慢性肺心病的表现，因此可确诊为慢阻肺并发慢性肺心病，其由于缺氧，CO₂潴留致肺血管收缩（A对），形成肺动脉高压。慢性缺氧产生继发性红细胞增多导致血红蛋白浓度升高（E错），血液黏稠增加，引起肺动脉高压，并不是由COPD导致肺动脉高压形成的机制。原位血栓形成（B错）是肺血栓栓塞的机制。肺小动脉结构重塑（D错）是肺动脉高压形成的解剖学因素，并不是最主要的机制。肺毛细血管静水压升高（C错）见于左心衰的患者。